患儿，女，9个月。右侧上唇Ⅲ度唇裂，其临床表现应是
A. 仅限于红唇部分的裂开
B. 上唇部分裂开，但鼻底尚完整
C. 整个上唇至鼻底完全裂开
D. 裂隙有红唇至部分白唇，未至鼻底
E. 仅唇白裂开，红唇完好

正确答案：C。整个上唇至鼻底完全裂开

解析：单侧唇裂：Ⅰ度唇度：仅限于红唇部分的裂开。Ⅱ度唇裂：上唇部分裂开，但鼻底尚完整。Ⅲ度唇裂：整个上唇至鼻底完全裂开。掌握“唇裂”知识点。